进行单侧唇裂整复术最适合的年龄为
A. 出生后即刻
B. 1～2个月
C. 3～6个月
D. 7～12个月
E. 1～2岁

正确答案：C。3～6个月

解析：一般认为，单侧唇裂整复术最合适的年龄为3～6个月，体重达6～7kg以上。早期进行手术，可以尽早地恢复上唇的正常功能和外形，并可使瘢痕组织减少到最小程度。对伴有牙槽突裂或腭裂的患儿，唇裂整复后，由于唇肌生理运动，可以产生压迫作用，促使牙槽突裂隙逐渐靠拢，为以后的腭裂整复创造条件。双侧唇裂整复术比单侧整复术复杂，术中出血相对较多，手术时间也较长，一般宜6～12个月时施行手术。此外，手术年龄还应该依据患儿全身健康状况及生长发育情况而定。掌握“唇腭裂的序列治疗”知识点。